牙周组织叙述错误的是
A. 包绕牙槽骨
B. 牙周膜位于牙根与牙颈之间
C. 牙周膜是致密结缔组织
D. 牙龈属于口腔黏膜
E. 牙龈覆盖于牙颈处

正确答案：B。牙周膜位于牙根与牙颈之间

解析：牙周组织包绕牙槽骨(A对)，牙周膜位于牙根与牙槽骨之间(B错，为本题正确答案)，为致密结缔组织(C对)，牙龈属于口腔黏膜(D对)，紧贴于牙颈处(E对)。